下列组织中最易完全再生修复的是
A. 心肌组织
B. 骨组织
C. 神经组织
D. 上皮组织
E. 平滑肌组织

正确答案：B。骨组织

解析：完全再生修复是指机体出现损伤时，以损伤周围的同种细胞对缺损进行修补，使组织恢复原本的结构和功能。各种组织的再生中最易完全再生修复的是骨组织（B对）。心肌细胞和神经细胞均属于永久性细胞，不能分裂增生，因此心肌组织（A错）和神经组织（C错）损伤后一般都是瘢痕修复（P33），但当外周神经受损时，如果与其相连的神经细胞仍然存活，则可完全再生。上皮组织（P32）（D错）虽然具有较强的再生能力，但再生情况依损伤的状态而异，如果基底膜被完全破坏，则难以再生。平滑肌组织（P33）（E错）有一定的分裂再生能力，但当损伤较大时，主要通过纤维瘢痕修复。